严重创伤引起DIC的主要原因是．
A. 大量红细胞和血小板受损
B. 凝血因子Ⅲ大量入血
C. 凝血因子Ⅻ被激活
D. 凝血因子X被激活
E. 直接激活凝血酶

正确答案：D。凝血因子X被激活

解析：凝血因子X被激活（D对BC错）是严重创伤引起DIC的主要原因，血液中的 FVll含有 Ca2+结合氨基酸，组织因子释放后，形成 TF-Ca2+-VII复合物，FVll被激活为FVlla。TF-Vlla 可激活FX，FXa与Va、PL-Ca2+形成凝血酶原激活物，凝血酶原被激活为凝血酶（E错），凝血酶使纤维蛋白原转变为纤维蛋白单体，纤维蛋白单体相互聚合，最终形成不溶于水的交联纤维蛋白多聚体。大量红细胞和血小板受损（A错）不属于严重创伤。